沟纹舌的发病可能与哪一项因素有关
A. 年龄因素
B. 家族遗传史
C. 脓疱性银屑病
D. 梅-罗综合征
E. 以上都有可能

正确答案：E。以上都有可能

解析：沟纹舌该病因不清，可能与以下因素有关：①年龄：有报告新生儿发病率约为0.8%，学龄儿童为5%～15%。10岁前发病率较低，10～60岁随年龄增加发病率增高，60岁后上升趋势停止。②遗传：有明显的家族史。③全身疾病：如脓疱性银屑病、梅-罗综合征等。掌握“地图舌、沟纹舌及舌乳头炎”知识点。